首先指出噎膈的基本病理为“脘管狭窄”者是
A. 叶天士
B. 徐灵胎
C. 张景岳
D. 王清任
E. 朱丹溪

正确答案：A。叶天士

解析：清·叶天士在《临证指南医案·噎膈反胃》中指出‘脘管窄隘’为本病的主要病机（A对）。